反映国内外医学重大新闻、最新进展和科研动态的网站是
A. 美国临床药学会网
B. 药学之窗网
C. 中国医学论坛报网
D. 国家临床技术情报网
E. 天然产物药师网

正确答案：C。中国医学论坛报网

解析：本题考查互联网站。中国医学论坛报网（C对）用于报道国内外医学重大新闻、最新进展和科研动态。美国临床药学会网（A错）上可看到临床药学学科领域的研究动态、专业热点、学术会议要点等有利于指导学科专业发展的信息。药学之窗网（B错）有药学知识、新药介绍、药学名人、药学软件等栏目。国家临床技术情报网（D错）为临床技术的专业网站。天然产物药师网（E错）提供天然产物的相关科研动态。